异丙肾上腺素临床可用于治疗
A. 重症肌无力
B. 支气管哮喘
C. 高血压
D. 内脏绞痛
E. 心动过速

正确答案：B。支气管哮喘

解析：本题考查异丙肾上腺素的临床应用。异丙肾上腺素的临床应用：①支气管哮喘急性发作（B对）；②房室传导阻滞；③心脏骤停；④休克。